放射性污染影响机体
A. 听觉系统
B. 心血管系统
C. 急慢性疾病和某些癌变
D. 免疫力
E. 血液循环

正确答案：C。急慢性疾病和某些癌变

解析：本题考查放射性污染对机体的影响。放射性污染是指由放射性物质造成的环境污染现象。放射性污染可以导致放射性元素、放射性同位素和放射性物质在人体内积累，从而导致急慢性疾病和某些癌变（C对ABDE错）。